男，45岁。休克病人，中心静脉压4cmH20，血压60／40mmHg，该病人可能
A. 血容量严重不足
B. 肾功能不全
C. 心功能不全
D. 肺功能不全
E. 容量血管过度舒张

正确答案：A。血容量严重不足

解析：患者为中年男性。休克病人，中心静脉压4cmH₂0（中心静脉压正常值为5～10cmH₂O），血压60／40mmHg（出现明显低血压），该病人可能血容量严重不足（A对）。中心静脉压代表了右心房或者胸腔段腔静脉内压力的变化，可反映全身血容量与右心功能之间的关系。中心静脉压偏低时，提示血容量不足，此时血压明显降低，且题干提示病人已处于休克，故推测病人可能出现低血容量性休克，即血容量严重不足。肾功能不全（B错）是休克中常出现的器官功能障碍，主要表现为少尿、无尿。心功能不全（C错）多出现心脏泵血功能下降，导致血压下降，静脉回流的血液难以排出，进一步出现中心静脉压升高。肺功能不全（D错）是休克中可能出现的器官功能障碍，主要表现为肺分流和无效腔通气增加，严重时导致急性呼吸窘迫综合症（ARDS）。容量血管过度舒张（E错）导致静脉血流大多滞留于外周容量血管中，但对整体的中心静脉压和血压影响并不大。